下列疾病中除哪项外均可采用拔罐法治疗
A. 风湿痹痛
B. 神经麻痹
C. 高热抽搐
D. 痛经
E. 痤疮

正确答案：C。高热抽搐

解析：拔罐法具有开泄腠理、祛风散寒、通经活络、行气活血、祛瘀生新、消肿止痛等作用。适用范围较广，常用于腹痛、颈肩腰腿痛、关节痛（风湿痹痛）（A对）、软组织闪挫扭伤等局部病证，也可用于伤风感冒、头痛、面瘫（神经麻痹）（B对）、咳嗽、哮喘、消化不良、泄泻、月经不调、痛经（D对）等病证，以及目赤肿痛、麦粒肿、丹毒、疮疡（E对）初起未溃等外科病证。高热抽搐（C错，为本题正确答案）需要退热息风止痉治疗，这不是拔罐法的作用。